有关儿童复发性腮腺炎说法中，正确的是
A. 不突发
B. 女性稍多于男性
C. 年龄越小，间隔时间越长
D. 以3岁左右最为常见
E. 挤压见导管口胶冻状液体溢出

正确答案：E。挤压见导管口胶冻状液体溢出

解析：儿童复发性腮腺炎发病年龄自婴幼儿至15岁均可发生，以5岁左右最为常见。男性稍多于女性，可突发，也可逐渐发生。腮腺反复肿胀，伴不适，肿胀不如流行性腮腺炎明显，仅有轻度水肿，皮肤可潮红。个别患儿表现为腮腺肿块，多为炎性浸润块。挤压腺体可见导管口有脓液或胶冻状液体溢出，少数有脓肿形成。大多数持续1周左右。静止期多无不适，检查腮腺分泌液偶有浑浊。间隔数周或数月发作一次不等。年龄越小，间隔时间越短，越易复发。随着年龄的增长，间歇时间延长，持续时间缩短。掌握“慢性复发性腮腺炎”知识点。